阵发性室上性心动过速首选药是
A. 尼莫地平
B. 尼群地平
C. 硝苯地平
D. 地尔硫卓
E. 维拉帕米

正确答案：E。维拉帕米

解析：具有一定的负性肌力、负性频率和负性传导的作用，并可引起冠脉和外周血管扩张。主要用于治疗室上性和房室结折返引起的心律失常效果好，对急性心肌梗死、心肌缺血及洋地黄中毒引起的室性早搏有效。为阵发性室上性心动过速首选药。掌握“钙通道阻滞药分类及代表药物”知识点。